Ⅱ型呼吸衰竭最主要的发生机制是
A. 通气/血流＞0.8
B. 通气/血流＜0.8
C. 弥散功能障碍
D. 肺动-静脉样分流
E. 肺泡通气不足

正确答案：E。肺泡通气不足

解析：Ⅱ型呼衰主要是缺氧同时伴有二氧化碳潴留，其主要发生机制为肺泡通气不足，肺泡通气量得减少，肺泡氧分压降低，二氧化碳分压升高，产生机体缺氧和二氧化碳潴留。掌握“呼吸衰竭”知识点。